女，36岁。慢性肾衰竭4年。1周来水肿加重伴恶心、呕吐、胸痛、呼吸困难。查体：T38.1℃，BP180/100mmHg，心前区可闻及心膜摩擦音。血红蛋白63g/L，血尿素氮28.6mmol/L，肌酐870.9umol/L。此患者病情危重的主要表现是
A. 内分泌失调
B. 高血压
C. 呼吸困难
D. 贫血
E. 水肿

正确答案：C。呼吸困难

解析：中年女性患者，既往有慢性肾衰竭病史4年。1周来水肿加重（水、钠潴留引起），伴恶心、呕吐（伴发胃肠道症状）。查体：T38.1℃（正常为36～37℃，考虑合并感染）。BP180/100mmHg（正常为90～130/60～90mmHg，提示血压升高），心前区可闻及心包摩擦音（提示合并心包积液，心包积液在慢性肾衰竭患者中常见，其原因多与尿毒症毒素蓄积、低蛋白血症、心力衰竭等有关），呼吸困难（心包积液最典型的表现）。血红蛋白63g/L（正常为110～150g/L，考虑肾性贫血），血尿素氮28.6mmol/L（正常值为3.2～7.1mmol/L，提示有氮质血症），肌酐870.9μmol/L（正常值为88.4～176.8μmol/L，提示血肌酐升高），根据我国慢性肾衰竭的分期方法判断（血肌酐≥707μmol/L为尿毒症阶段），患者处于尿毒症期。呼吸困难（C对）若不及时处理有可能导致呼吸衰竭、甚至窒息，心脏骤停，引起死亡。其他临床表现如内分泌失调（A错）、高血压（B错）、贫血（D错）、水肿（E错）都是慢性肾衰竭进展缓慢的症状，一般不会导致患者在短期内死亡。